某女，27岁。月经或提前或错后，经量时多时少，色暗红或紫红，夹有血块，经行不畅，胸胁、乳房、少腹胀痛，脘闷不舒，时叹息，嗳气食少；苔薄黄，脉弦。宜选用的基础方剂是
A. 固阴煎
B. 膈下逐瘀汤
C. 温经汤
D. 人参归脾丸
E. 逍遥散

正确答案：E。逍遥散

解析：本题考查的是月经先后无定期的辨证论治。月经或提前或错后，经量时多时少，色暗红或紫红，夹有血块，经行不畅，胸胁、乳房、少腹胀痛，脘闷不舒，时叹息，嗳气食少；苔薄黄，脉弦。宜选用的基础方剂是逍遥散（E对）。月经周期时或提前时或延后7天以上，连续3个周期以上者，称为“月经先后无定期”。又称“经水先后无定期”“月经愆期”“经乱”等。本病以月经周期紊乱为特征，可连续两个周期提前又出现一次延后，或两三个周期错后，又见一次提前，或见提前延后错杂更迭不定。西医学排卵性功能失调性子宫出血出现月经先后无定期征象者可按本病治疗。（一）肾虚证：【症状】经行或先或后，量少，色淡暗，质稀薄；或腰骶酸痛，或头晕耳鸣。舌淡苔白，脉细弱。【方剂应用】基础方剂为固阴煎（A错）（熟地、山药、山茱萸、人参、炙甘草、五味子、菟丝子、远志）加减。（二）肝郁证：【症状】经来先后无定，经量或多或少，色暗红或紫红，有血块，或经行不畅；胸胁、乳房、少腹胀痛，脘闷不舒，时叹息，嗳气食少。苔薄白或薄黄，脉弦。【方剂应用】基础方剂为逍遥散（柴胡、当归、白芍、白术、茯苓、甘草、薄荷、煨姜）加减。（三）脾虚证：【症状】经来先后无定，经量多，色淡质稀，神倦乏力，脘腹胀满，纳呆食少。舌淡，苔薄，脉缓。【方剂应用】基础方剂为归脾汤（人参、黄芪、白术、当归、茯神、龙眼肉、远志、酸枣仁、木香、甘草、生姜、大枣）加减。膈下逐瘀汤（B错）为痛经气滞血瘀证的方剂应用。痛经气滞血瘀证：【症状】经前或经期小腹胀痛，经血量少，行而不畅，经色紫暗有块，块下则痛减；乳房胀痛，胸闷不舒。舌质紫暗或有瘀点，脉弦。【方剂应用】基础方剂为膈下逐瘀汤（当归、川芎、赤芍、桃仁、红花、枳壳、延胡索、五灵脂、丹皮、乌药、香附、甘草）加减。温经汤（C错）为痛经寒凝血瘀证的中成药应用。痛经寒凝血瘀证：【症状】经行小腹冷痛，得热则舒，经量少，色紫暗有块；形寒肢冷小便清长。脉细或沉紧。【方剂应用】基础方剂为少腹逐瘀汤（小茴香、干姜、延胡索、没药、当归、川芎、肉桂、赤芍、蒲黄、五灵脂）加减。人参归脾丸（D错）为月经先期脾气虚证的中成药应用。月经先期脾气虚证：【症状】月经周期提前，经量多，色淡红，质清稀；神疲乏力，气短懒言，小腹空坠，纳少便溏。舌淡红，苔薄白，脉细弱。【方剂应用】基础方剂为补中益气汤（黄芪、炙甘草、人参、当归、橘皮、升麻、柴胡、白术）或归脾汤（人参、黄芪、白术、当归、茯神、龙眼肉、酸枣仁、木香、远志、甘草、生姜、大枣）加减。